动眼神经不支配的眼外肌是
A. 上直肌
B. 内直肌
C. 外直肌
D. 下斜肌
E. 下直肌

正确答案：C。外直肌

解析：动眼神经的一般躯体运动纤维支配的眼外肌包括上直肌（A错）、内直肌（B错）、下斜肌（D错）、下直肌（E错）等。不支配的眼外肌是外直肌，外直肌（C对）由展神经支配。